女性，35岁，脾切除小肠切除吻合术后第5天，已排气，头痛恶心腹胀，随后出现寒颤，四肢发绀，体温39.6℃，脉搏108次/分，血压135/85mmHg，近24小时尿量650ml，轻度腹胀，腹软，全腹轻压痛，无反跳痛及肌紧张，肠鸣音3次/分。最有可能出现异常的是
A. 白细胞计数
B. 尿常规检查
C. 立位腹部透视
D. 腹部B超声检查
E. 血清钾离子

正确答案：A。白细胞计数

解析：本例患者脾切除、肠切除术后5天，出现头痛、恶心、寒颤、高热（39.1～41℃即为高热），四肢发绀等症状，提示感染，最有可能出现异常的是白细胞计数（A对）。尿常规检查（B错）异常多提示泌尿系统疾病，而患者尿量正常、无其他泌尿系症状。立位腹部透视（C错）可发现腹腔积气、积液协助诊断腹腔出血、腹膜炎或吻合口瘘，本例患者虽有轻度腹胀，但血压稳定、已排气、腹软、无腹膜刺激征表现（压痛、反跳痛及肌紧张）、肠鸣音正常，可基本排除腹腔出血、腹膜炎及术后吻合口瘘；血清钾离子（E错）升高或降低均会有四肢乏力的表现，本例患者没有乏力的表现。